某医院急诊医生接诊了一位遭遇车祸后昏迷的患者，立即给予了心肺复苏、气管插管等抢救措施。此时的医患关系所属的类型是
A. 共同参与型
B. 主动-被动型
C. 指导合作型
D. 合作-监督型
E. 主动权威型

正确答案：B。主动-被动型

解析：医患关系分为三种类型：主动-被动型、指导-合作型、共同参与型（DE错）。主动-被动型（B对）指医师主动命令，病人被动服从，适合难以表述自己主观意见的病人，如麻醉、严重外伤昏迷的病人等。共同参与型（A错）指医患双方共同制定并实施诊断方案，适合慢性疾病病人和心理疾病病人。指导-合作型（C错）是指在医疗活动中，医患双方具有一定的主动性，但仍以医务人员为主，适合于急性感染期病人。